氨甲蝶呤可用于治疗白血病的原因是其可以直接
A. 抑制二氢叶酸还原酶
B. 抑制DNA的合成酶系的活性
C. 抑制蛋白质的分解代谢
D. 阻断蛋白质的合成代谢
E. 破坏DNA的分子结构

正确答案：A。抑制二氢叶酸还原酶